全口义齿初戴时，选磨方式错误的是
A. 选磨正中（牙合）早接触时，主要选磨与早接触支持尖相对应的近远中边缘嵴和中央窝
B. 选磨侧方（牙合）干扰时，选磨少数非支持尖上的（牙合）干扰点
C. 选磨侧方（牙合）干扰时，如为尖牙的干扰通常以选磨上尖牙为主
D. 前伸（牙合）不干扰时，如前牙接触而后牙不接触时，选磨以下前牙唇斜面为主
E. 前伸（牙合）不干扰时，如后牙接触而前牙不接触时，选磨上牙尖的远中斜面或下牙尖的近中斜面

正确答案：C。选磨侧方（牙合）干扰时，如为尖牙的干扰通常以选磨上尖牙为主

解析：本题考查选磨的方法。全口义齿初戴时，选磨方式错误的是选磨侧方（牙合）干扰时，如为尖牙的干扰通常以选磨上尖牙为主（C错，为本题的正确答案）。①选磨正中（牙合）早接触时，主要选磨与早接触支持尖相对应的近远中边缘嵴和中央窝（A对）。②选磨侧方（牙合）干扰时，选磨少数非支持尖上的（牙合）干扰点，只选磨单颌，直到所有非支持尖都有接触点为止（B对），通常以选磨下尖牙为主。③选磨前伸（牙合）干扰时，如前牙接触而后牙不接触时，选磨以下前牙唇斜面为主（D对），如后牙接触而前牙不接触时，选磨上牙尖的远中斜面或下牙尖的近中斜面（E对）。